女性，65岁。冠心病心绞痛史8年，无高血压史，夜间突发心前区疼痛8小时入院，入院时血压为150/90mmHg（20/12kPa），经心电图检查，诊断急性前壁心肌梗死。第2日患者出现胸闷大汗面色苍白，体检心率126次/分，律齐，血压80/50mmHg，双肺满布中小水泡音。此时患者的心功能分级为
A. Killip分级Ⅳ级
B. Killip分级Ⅲ级
C. 纽约心脏病协会（NYHA）分级Ⅳ级
D. 纽约心脏病协会（NYHA）分级Ⅲ级
E. 全心衰竭

正确答案：A。Killip分级Ⅳ级

解析：患者老年女性，有心绞痛病史，急性前壁心肌梗死诊断明确，故患者心功能分级应按Killip分级法。患者血压80/50mmHg（＜90/60mmHg），双肺满布中小水泡音，提示患者已有休克症状，此时患者的心功能分级为Killip分级Ⅳ级（A对）。KilliP分级Ⅲ级（B错）时有急性肺水肿，全肺可闻及湿啰音，但无休克表现。纽约心脏病协会（NYHA）分级主要心力衰竭患者的心功能分级，患者绝无急性心肌梗死，纽约心脏病协会（NYHA）分级Ⅳ级（C错）是指心脏患者不能从事任何体力活动，休息状态也存在心衰症状。纽约心脏病协会（NYHA）分级Ⅲ级（D错）指心脏病患者体力活动明显受限，低于平时一般活动即可引起心衰症状。右心衰竭继发于左心衰竭形成全心衰竭（E错），但该患者无恶心呕吐，颈静脉怒张，下肢水肿等右心衰表现，故不能诊断为全心衰。